在病例对照研究中，调查对象应是
A. 病例组选择怀疑患某病的人，对照组应选择未患某病的人
B. 病例组应是确定患某病的人，对照组为怀疑患某病的人
C. 病例和对照均是患某病的人
D. 病例应是确定患某病的人，对照应是不患某病的人

正确答案：D。病例应是确定患某病的人，对照应是不患某病的人

解析：本题考查病例对照研究的调查对象。病例对照研究的调查对象是以当前已经确诊的患有某特定疾病的一组病人作为病例组，以不患有该病但具有可比性的一组个体作为对照组（D对ABC错）。